骨骼肌神经-肌接头兴奋传递中，形成终板电位的主要离子流是
A. K⁺外流
B. Na⁺内流
C. Ca²⁺内流
D. Cl⁻内流
E. H⁺外流

正确答案：B。Na⁺内流